有害效应阈值和非有害效应阈值应分别在（）之间（注：未观察到作用的水平，NOEL；观察到作用的最低水平，LOEL；未观察到有害作用水平，NOAEL；观察到损害作用的最低水平，LOAEL）
A. NOAEL和LOEL；NOEL和LOAEL
B. NOEL和LOAEL；NOAEL和LOEL
C. NOAEL和LOAEL；NOEL和LOEL
D. NOEL和LOEL；NOAEL和LOAEL

正确答案：C。NOAEL和LOAEL；NOEL和LOEL

解析：本题考查效应阈值的相关内容。有害效应阈值和非有害效应阈值应分别在NOAEL（未观察到有害作用水平）和LOAEL（观察到损害作用的最低水平）；NOEL（未观察到作用的水平）和LOEL（观察到作用的最低水平）（C对ABD错）之间。